右心衰特征性表现
A. 肝颈静脉回流征阳性
B. 颈静脉搏动
C. 双肺底对称细湿啰音
D. 多浆膜腔积液
E. 下肢水肿

正确答案：A。肝颈静脉回流征阳性

解析：肝颈静脉回流征阳性（A对）是右心衰竭的的特征性表现。颈静脉搏动（B错）多浆膜腔积液（D错）下肢水肿（E错）也是右心衰竭的表现，但不是最具特征性的。双肺底对称细湿啰音（C错）是左心衰竭的表现。